智力、个性和社会行为发育的关键期和特殊敏感期是在
A. 新生儿期
B. 儿童早期
C. 儿童中期
D. 儿童晚期
E. 青春期早期

正确答案：B。儿童早期

解析：本题考查儿童心理卫生重要性及影响其心理健康因素。儿童早期（B对ACDE错）是智力、个性和社会行为发育的关键期和特殊敏感期,儿童心理社会发展偏离和各种心理障碍直接影响儿童健康的发展,并对其一生都将产生深远的影响。